玉液汤的组成药物中含有
A. 鸡内金
B. 麦芽
C. 山楂
D. 莱菔子
E. 神曲

正确答案：A。鸡内金

解析：根据考点还原可作出判断。玉液汤中含有鸡内金（A对）。记忆：玉液山药芪葛根，花粉知味鸡内金。